正常情况下，肾脏近端小管对Na⁺和水的重吸收率
A. 约占滤液量的99%
B. 受肾小球滤过率的影响
C. 与葡萄糖的重吸收率平行
D. 受血管升压素的调节
E. 受醛固酮的调节

正确答案：B。受肾小球滤过率的影响

解析：肾脏近端小管对Na⁺和水的重吸收率为65%～70%（A错）。近端小管对溶质（特别是Na⁺）和水的重吸收随肾小球滤过率的变化而改变，受肾小球滤过率的影响（B对）。在近端小管的前半段，Na⁺进入上皮细胞的过程与葡萄糖的转运相偶联，但是在近端小管后半段与葡萄糖的转运没有关系（C错）。在远端小管和集合管，水的重吸收则主要受血管升压素的调节（D错），Na⁺的重吸收主要受醛固酮的调节（E错）。